25岁初产妇，妊娠39周，阵发性腹痛20小时，10～12分钟宫缩一次，持续30秒，宫口开大2cm。此时的处理原则应是
A. 肌内注射缩宫素
B. 静脉滴注麦角新碱
C. 肌内注射哌替啶
D. 人工破膜
E. 立即行剖宫产术

正确答案：C。肌内注射哌替啶

解析：青年初产妇，宫口扩张2cm，阵发性腹痛达20小时，潜伏期延长（潜伏期是指宫口开始扩张至开大3cm，需8小时，最大时限16小时），10～12分钟宫缩一次（＞5～6分钟），持续30秒，可考虑为协调性宫缩乏力，可肌内注射哌替啶（C对）用于促进宫颈软化而促进宫颈扩张，强子宫收缩力。本题未提及胎儿情况，所以不能直接使用缩宫素（A错）。麦角新碱（B错）可选择性兴奋子宫平滑肌，但剂量稍大即可引起子宫平滑肌强直收缩，妊娠后期子宫对其敏感性增强，一般用于产后子宫出血，不用于催产和引产。经过人工破膜（D错）适用于宫口开大3cm以上。经过保守治疗无效或出现胎儿呼吸窘迫征象时，应及时行剖宫产术（E错）。